女性青春期最早出现的是
A. 月经来潮
B. 乳房发育
C. 体格发育
D. 骨盆变化
E. 脂肪蓄积

正确答案：B。乳房发育

解析：青春期按照顺序先后经历四个不同的阶段，各阶段有重叠，共需大约4.5年的时间。乳房发育（B对）是女性第二性征最早出现的特征。第二阶段是肾上腺功能初现，肾上腺雄激素分泌增加引起阴毛和腋毛的生长。第三阶段是生长加速期，11～12岁青春期少女体格发育（C错）呈直线加速，平均每年生长9cm。第四阶段是月经来潮（A错），平均晚于乳房发育2.5年时间。骨盆横径发育大于前后径（D错），以及胸、肩部皮下脂肪增多（E错）均出现于乳房发育后。